下列哪种情况不适宜做桩核冠
A. 年轻恒牙
B. 根尖有感染的牙且未得到控制
C. 根管壁有侧穿的牙
D. 牙槽骨吸收超过根1/2的牙
E. 以上都不适宜做

正确答案：E。以上都不适宜做

解析：桩核冠的适应证①牙冠大部分缺损无法充填治疗或做全冠修复固位不良者。②牙冠缺损至龈下，牙周健康，牙根有足够的长度，经牙冠延长术或正畸牵引术后能暴露出断面以下约1.5mm者。③错位牙、扭转牙而非正畸治疗适应证者。④作固定义齿的固位体的残冠残根。核冠的禁忌证：年轻恒牙、根尖发育尚未完成、牙根吸收严重者。掌握“牙体缺损修复体固位及适应、禁忌证”知识点。